三臂卡环的组成不包括
A. 卡环体
B. 小连接体
C. 卡环臂
D. 支托
E. 邻面板

正确答案：E。邻面板

解析：本题考查卡环的种类。三臂卡环的组成不包括邻面板（E错，为本题正确答案）。邻面板是RPI卡环组的组成结构。